治疗乳汁不足的腧穴是
A. 中冲
B. 隐白
C. 少泽
D. 少冲
E. 大敦

正确答案：C。少泽

解析：中冲主治中风昏迷、舌强不语、中暑、昏厥、小儿惊风等急症（A错）。隐白主治月经过多、崩漏等妇科病；便血、尿血等慢性出血证；癫狂，多梦；惊风；腹满，暴泻（B错）。少泽主治乳痈、乳汁少等乳疾；昏迷、热病等急症、热证；头痛、目翳、咽喉肿痛等头面五官病证（C对），少泽为通乳要穴。少冲主治心悸、心痛、癫狂、昏迷等心及神志病证；热病；胸胁痛（D错）。大敦主治疝气、少腹痛；遗尿、癃闭、五淋、尿血等泌尿系病证；月经不调、崩漏、阴缩、阴中痛、阴挺等月经病及前阴病；癫痫，善寐（E错）。